普萘洛尔具有的作用是
A. 减少心输出量
B. 促进肾素分泌
C. 不引起支气管收缩
D. 引起血管收缩
E. 增强心肌收缩力

正确答案：A。减少心输出量

解析：作用机制：普萘洛尔为非选择性β受体阻断药，降压机制与阻断β受体有关。①阻断心脏β₁受体，使心肌收缩力减弱（E错），心排血量减少（A对）；②阻断肾小球旁细胞上的β₁受体，使肾素分泌减少（B错），AngⅡ生成减少；③阻断血管的去甲肾上腺素能神经突触前膜上的β₂受体，抑制其正反馈作用，减少NA的释放；④抑制下丘脑、延髓等部位的β受体，抑制兴奋性神经元，降低交感神经中枢的张力；⑤降低血管壁上压力感受器的敏感性；⑥增加前列环素的合成，扩张血管（D错）。不良反应：因收缩支气管平滑肌和血管平滑肌（C错），伴有支气管哮喘、外周血管痉挛性疾病患者禁用；